溶血性链球菌主要引起的炎症是
A. 脓肿
B. 出血性炎
C. 假膜性炎
D. 纤维素性炎
E. 蜂窝织炎

正确答案：E。蜂窝织炎

解析：溶血性链球菌主要引起的炎症是蜂窝织炎（E对）。脓肿（A错）主要由金黄色葡萄球菌引起。纤维素性炎（P75）（D错）多由某些细菌毒素（如白喉杆菌、痢疾杆菌和肺炎球菌的毒素）或各种内源性和外源性毒物（如尿毒症的毒素和汞中毒）引起。假膜性炎（C错）是发生于黏膜的纤维素性炎，常有白喉杆菌、痢疾杆菌等引起。出血性炎（B错）主要由钩端螺旋体、鼠疫杆菌等引起。